已被用于人流感病毒疫苗的是
A. DCs
B. AS04
C. MF58
D. MF59
E. IL-18

正确答案：D。MF59

解析：MF59是以角鲨烯（squalene）为油相的水包油乳化剂，已被用于人流感病毒疫苗。掌握“抗原基本概念、分类、超抗原及佐剂”知识点。